患者，男，33岁。患疕，发病较久，皮疹多呈斑片状，颜色淡红，鳞屑减少，干燥皲裂，自觉瘙痒，伴口干，舌质淡红，苔少，脉沉细。其治法是
A. 清热泻火，凉血解毒
B. 清利湿热，解毒通络
C. 活血化瘀，解毒通络
D. 养血滋阴，润肤熄风
E. 清热凉血，解毒消斑

正确答案：D。养血滋阴，润肤熄风

解析：该患者其皮疹多呈斑片状，颜色淡红，鳞屑减少，干燥皲裂，自觉瘙痒，可诊断为白疕；口咽干燥；舌质淡红，苔少，脉沉细符合血虚的表现，故辨为血虚风燥证。清热泻火，凉血解毒为白疕火毒炽盛证的治法（A错）。清利湿热，解毒通络为白疕湿毒蕴阻证的治法（B错）。活血化瘀，解毒通络为白疕气滞血瘀证的治法（C错）。养血滋阴，润肤熄风为白疕血虚风燥证的治法（D对）。清热凉血，解毒消斑为白疕血热内蕴证的治法（E错）。